关于《土地污染防治行动计划》（下称“土十条”）不正确的是
A. 是全国第一份土壤治污领域的纲领性文件，它制定从目前到2020年的土壤污染防治行动
B. “土十条”首要任务即“开展土壤污染调查，掌握土壤环境质量状况”
C. “土十条”提出2020年受污染耕地安全利用率达到90%左右，污染地块安全利用率达90%以上
D. 提出“谁污染，谁治理”原则，造成土壤污染的单位或个人要承担治理与修复的主体责任
E. 到2020年，全国土壤污染加重趋势得到初步遏制，到2030年，土壤环境质量全面改善

正确答案：E。到2020年，全国土壤污染加重趋势得到初步遏制，到2030年，土壤环境质量全面改善

解析：本题考查《土地污染防治行动计划》（下称“土十条”）。《土地污染防治行动计划》（下称“土十条”）是全国第一份土壤治污领域的纲领性文件，它制定出从目前到2020年的土壤污染防治行动计划（A对）。“土十条”首要任务即“开展土壤污染调查，掌握土壤环境质量状况”（B对）。在主要指标方面，“土十条“提出，到2020年受污染耕地安全利用率达90%左右，污染地块安全利用率达90%以上（C对）。到2030年，受污染耕地安全利用率达95%以上，污染地块安全利用率达95%以上。相关主体的规定：①地方各级人民政府是实施《行动计划》的主体，要于2016年底前分别制定并公布土壤污染防治工作方案，确定重点任务和工作目标。②治理和修复主体，提出“谁污染，谁治理”原则，造成土壤污染的单位或个人要承担治理与修复的主体责任（D对）。土地污染防治行动计划目标：到2020年，全国土壤污染加重趋势得到初步遏制；到2030年，全国土壤环境质量稳中向好；到本世纪中叶，土壤环境质量全面改善（E错，为本题正确答案）。